对新建、改建、扩建的饮用水供水工程项目进行审查的部门是
A. 卫生行政主管部门
B. 建设行政主管部门
C. 质量技术监督部门
D. 环保行政主管部门
E. 食品药品监督管理部门

正确答案：B。建设行政主管部门